儿童心理发育不包括
A. 语言
B. 思维
C. 情绪
D. 独立性和自我意识
E. 唱歌、音乐、技巧等才能教育

正确答案：E。唱歌、音乐、技巧等才能教育

解析：本题考查神经心理发育相关内容。唱歌、音乐、技巧等才能教育（E错，为本题正确答案）属于技能。神经心理发育也称精神发育，包括感知觉、动作、语言（A对）、注意、记忆、思维（B对）、想象、情绪（C对）情感、意志、性格（D对）、社会性等方面的发育。